患者，男，25岁。因昏迷而送来急诊。查体，深昏迷状态，呼吸有轻度大蒜味，疑为有机磷中毒。下列哪项对诊断最有帮助
A. 瞳孔缩小
B. 呕吐物有大蒜臭味
C. 大小便失禁
D. 肌肉抽动
E. 全血胆碱醋酶活力降低

正确答案：E。全血胆碱醋酶活力降低

解析：全血胆碱酯酶活力降低（E对）是对有机磷农药中毒诊断最有帮助的辅助检查。瞳孔缩小（A错）、大小便失禁（C错）是由于副交感神经末梢过度兴奋，产生的毒蕈碱样症状。呕吐物有大蒜臭味（B错）是有机磷中毒的症状，但不是最有帮助的诊断。肌肉抽动（D错）为烟碱样症状。